枸橼酸芬太尼含有
A. 吗啡喃结构
B. 苯吗喃结构
C. 哌啶结构
D. 氨基酮结构
E. 环己基胺结构

正确答案：C。哌啶结构

解析：本题考查哌替啶类镇痛药。橼酸芬太尼（C对）是在4-苯基哌啶结构中哌啶环的4位引入苯氨基，并在苯基氨基的氮原子上丙酰化得到4-苯氨基哌啶类结构的强效镇痛药。吗啡喃类化合物是吗啡分子去除E环（呋喃环）后的衍生物，枸橼酸芬太尼不含吗啡喃结构（A错）。进一步简化吗啡喃的结构，打开C环，仅保留A、B、D 环，形成苯并吗喃类，C环裂开后在原处保留小的烃基作为C环残基，立体构型与吗啡更相似，镇痛作用增强，枸橼酸芬太尼不含苯吗喃结构（B错）。氨基酮类镇痛药中含有氨基酮结构（D错），代表药物为美沙酮。枸橼酸芬太尼不含环己基胺结构（E错）。